阻塞性睡眠呼吸暂停综合征的治疗方案中，选用适合的正颌外科手术可有效的解除或缓解症状，可选用
A. 全上颌骨水平向骨切开术
B. 经口内下颌升支斜形骨切开术
C. 经口内下颌升支矢状骨劈开术
D. 上颌前份节段性骨切开术
E. 下颌前部根尖下骨切开术

正确答案：C。经口内下颌升支矢状骨劈开术

解析：本题考查阻塞性睡眠呼吸暂停综合征的正颌外科手术治疗。阻塞性睡眠呼吸暂停综合征的治疗方案中，选用适合的正颌外科手术可有效的解除或缓解症状，可选用经口内下颌升支矢状骨劈开术（C对）。阻塞性睡眠呼吸暂停综合征的病因复杂，比较集中的看法是上气道软组织塌陷和上气道结构异常造成的上气道梗阻的长期作用，导致呼吸中枢的调节机制发生障碍所致。正颌外科是通过手术的方式，使整体或部分颌骨连同相应的软组织向前移动，这种前徙也包括附着于颌骨上肌肉的位置、长度、受力角度的变化，从而达到改变舌根、舌骨等上气道相关结构位置，扩大上气道，达到治疗目的。下颌前徙术，主要采用经双侧经口内下颌升支矢状骨劈开术来前徙下颌骨，这对伴有明显的下颌后缩或小下颌的阻塞性睡眠呼吸暂停综合征患者有显著治疗效果。全上颌骨水平向骨切开术（A错）主要用于矫治涉及上颌骨大小与位置异常的畸形。经口内下颌升支斜形骨切开术（B错）主要用于矫治下颌后退不超过10mm的骨性下颌前突，配合上颌手术矫正双颌畸形。上颌前份节段性骨切开术（D错）主要用于上颌前牙及牙槽骨前突，配合下颌前部根尖下骨切开术矫治双颌前突。下颌前部根尖下骨切开术（E错）主要用于矫治下颌前牙及牙槽骨前突，常配合上颌前部骨切开术矫治双颌前突。